可引起中毒性表皮坏死的药物是
A. 阿司匹林
B. 磺胺甲噁唑
C. 卡托普利
D. 奎尼丁
E. 两性霉素B

正确答案：B。磺胺甲噁唑

解析：本题考查药源性疾病。可引起中毒性表皮坏死的药物是磺胺甲噁唑（B对）；阿司匹林（A错）后可引起过敏反应；卡托普利（C错）可引起肾功能损害、肾病综合征、肾小球肾炎等；奎尼丁（D错）可引起尖端扭转性室性心动过速；两性霉素B（E错）可引起急性肾小管坏死。